发自肝固有动脉的是
A. 胃短动脉
B. 胃左动脉
C. 胃网膜左动脉
D. 胃网膜右动脉
E. 胃右动脉

正确答案：E。胃右动脉

解析：胃右动脉（E对）发自肝固有动脉，胃右动脉沿胃小弯向左行，与胃左动脉吻合，沿途分支布于胃小弯侧的胃壁。